与洋地黄苷结合，能阻断肝肠循环，减轻中毒的药物是
A. 地高辛抗体
B. 考来烯胺
C. 氢氯噻嗪
D. 阿托品
E. 苯妥英钠

正确答案：B。考来烯胺